早期无症状，随着肿瘤增大，可由于颌骨膨隆引起牙移位、关系紊乱和颌面部变形。X线表现为境界清楚的、单房性密度减低区，由于伴有硬组织形成，在病变的中央区域常见不透光区，此为以下哪种疾病的临床表现
A. 骨化纤维瘤
B. 成牙骨质细胞瘤
C. 牙源性纤维瘤
D. 舌下囊肿
E. 皮样囊肿

正确答案：A。骨化纤维瘤

解析：骨化纤维瘤早期无症状，随着肿瘤增大，可由于颌骨膨隆引起牙移位、关系紊乱和颌面部变形。X线表现为境界清楚的、单房性密度减低区，由于伴有硬组织形成，在病变的中央区域常见不透光区。掌握“骨化纤维瘤”知识点。